治疗癫痫部分发作的一线药有
A. 左旋多巴
B. 氯丙嗪
C. 加巴喷丁
D. 卡马西平
E. 丙咪嗪

正确答案：D。卡马西平

解析：本题考查抗癫痫药。治疗癫痫部分发作的一线药有卡马西平（D对）、丙戊酸钠、苯妥英钠等。左旋多巴（A错）为抗震颤麻痹药。氯丙嗪（B错）为抗精神病药，还用于治疗心力衰竭。加巴喷丁（C错）用于治疗难治的不全性癫痫，可作为治疗癫痫部分发作的替代药。丙咪嗪（E错）有较强的抗抑郁作用。